《素问·痹论》认为肠痹的症状有
A. 发咳呕汁
B. 善噫
C. 数饮而出不得
D. 厥气上则恐
E. 多饮数小便

正确答案：C。数饮而出不得

解析：肠痹者，数饮而出不得，中气喘争，时发飧泄（C对）。脾痹者，四支解堕，发咳呕汁，上为大塞（A错）。心痹者，脉不通，烦则心下鼓，暴上气而喘，嗌干，善噫（B错），厥气上则恐（D错）。肝痹者，夜卧则惊，多饮数小便，上为引如怀（E错）。